引起病人右侧眼睑下垂，右侧瞳孔散大的最可能原因是
A. 面神经麻痹
B. 动眼神经麻痹
C. 小脑幕切迹疝
D. 糖尿病眼底病
E. 右侧视神经损害

正确答案：B。动眼神经麻痹

解析：动眼神经是支配眼肌的主要神经，其外侧核支配上睑提肌、上直肌、内直肌、下斜肌、下直肌，E-W核支配瞳孔括约肌和睫状肌。故动眼神经麻痹（B对）表现为眼睑下垂、瞳孔散大及光反射及调节反射均消失。面神经麻痹（A错）表现为面瘫。小脑幕切迹疝（C错）除可表现为动眼神经麻痹症状外，还伴有明显颅内压增高、意识障碍进行性恶化。糖尿病眼底病（D错）有糖尿病史，眼部表现主要为眼底微小血管病变，无眼睑下垂及瞳孔缩小表现。右侧视神经损害（E错）主要表现为视力障碍和视野缺损。